穿心莲内酯在碱液中易
A. 氧化
B. 聚合
C. 变旋
D. 水解
E. 品型转换

正确答案：D。水解

解析：本题考查的是酯类药物的水解。穿心莲内酯在碱液中易水解（D对）。酯类药物制成水溶液时要特别注意pH的调节。一般而言，溶液碱性愈强，水解愈快，如穿心莲内酯在pH7时内酯环水解极其缓慢，而在偏碱性溶液中则水解加快。易氧化（A错）的药物主要包括：具有酚羟基或潜在酚羟基的有效成分，如黄芩苷等。含有不饱和碳链的油脂、挥发油等，在光线、氧气、水分、金属离子以及微生物等影响下，都能产生氧化反应。药物暴露在日光下，可引起光化反应。如因光线照射酚类药物可产生氧化反应、酯类药物可产生水解反应、挥发油可产生聚合（B错）反应等。变旋（C错）作用是指一个吡喃糖、呋喃糖或糖苷伴随着它们的α-和β-异构形式的平衡而发生的比旋度变化。